男，65岁，上腹部无规律性隐痛2个月，因饮酒后呕咖啡样物150ml，柏油便300ml来诊，无肝病史。查体：血压90/60mmHg，脉搏100次/分，血红蛋白90g/L，上腹部轻度压痛，肝脾肋下未触及，其止血措施最好选择
A. 维生素K₁静滴
B. 奥美拉唑静注
C. 6-氨基己酸静滴
D. 三腔二囊管压迫
E. 垂体后叶素静滴

正确答案：B。奥美拉唑静注

解析：老年男性患者，既往无肝病史，上腹部无规律性隐痛2个月（消化性溃疡或胃癌的常见症状），因饮酒后呕咖啡样物150ml、柏油便300ml（提示上消化道出血）。查体：血红蛋白90g/L（正常为120～160g/L，提示为上消化道大量出血引起的血红蛋白降低）；血压90/60mmHg（正常>90/60mmHg）、脉搏100次/分（正常为60～100次/分），血压降低、脉搏细速为上消化道大量出血引起休克的表现。综合患者的病史、症状、体征，考虑胃溃疡出血的可能性大。根据急性非静脉曲张性上消化道出血诊治指南（2012），止血措施有：①内镜下止血：起效迅速、疗效确切，应作为首选；②抑酸药物：包括质子泵抑制剂（PPI）如奥美拉唑、H₂受体拮抗剂（H₂RA）如雷尼替丁等，有利于止血和预防再出血，又可治疗溃疡。PPI止血效果显著优于H₂RA，故首选奥美拉唑静注（B对）；③止血药：对于没有凝血功能障碍或继发纤溶亢进的患者，应避免使用此类药物，如维生素K1、6-氨基己酸、垂体后叶素（ACE错）；④选择性血管造影及栓塞治疗；⑤手术。三腔二囊管压迫（D错）对食管胃底静脉曲张出血者疗效佳，不适用于溃疡性出血。